关于外毒素的叙述，哪一项是错误的
A. 化学成分是蛋白质
B. 毒性作用强，对组织有选择性
C. 受甲醛处理形成类毒素
D. 毒性部分是类脂A
E. 多由G+菌产生，不耐热

正确答案：D。毒性部分是类脂A

解析：外毒素毒性很强。最强的肉毒毒素1毫克纯品能杀死2亿只小鼠，其毒性比化学毒剂氰化钾还要大1万倍。不同病原菌产生的外毒素，对机体的组织器官具有选择性（医学上称为亲嗜性），引起特殊的病理变化。外毒素是一类蛋白质，它能刺激宿主免疫系统产生良好的免疫应答反应，形成能中和外毒素毒性的特异性免疫球蛋白，这种球蛋白称为抗毒素。（内毒素是脂多糖）按细菌外毒素对宿主细胞的亲嗜性和作用方式不同，可分成神经毒素（破伤风痉挛毒素、肉毒毒素等）、细胞毒素（白喉毒素、葡萄球菌毒性休克综合征毒素1、A群链球菌致热毒素等）和肠毒素（霍乱弧菌肠毒素、葡萄球菌肠毒素等）三类。掌握“医院感染及细菌的致病性”知识点。